首先考虑为肝硬化腹水的是
A. 漏出液
B. 渗出液
C. 血性
D. 脓性
E. 乳糜性

正确答案：A。漏出液

解析：肝硬化会导致门静脉压力升高、有效循环血容量不足、白蛋白合成减少、继发性醛固酮和抗利尿激素增多、淋巴液生成增多，这些因素可以导致血浆胶体渗透压降低、毛细血管内流体静脉压升高，从而在腹腔产生漏出液（A对），形成腹水。渗出液（B错）为炎性积液，主要见于感染、外伤、化学刺激、风湿性疾病等。血性（C错）积液主要见于外科手术、肝癌、结核性腹膜炎等。脓性（D错）积液由化脓性细菌感染引起，主要见于腹膜腔化脓性炎症等。乳糜性（E错）积液常常是由于淋巴回流受阻所致，主要见于结核等。